儿童脑发育速度开始减慢、脑的大小达到成人的80%的年龄期是
A. 新生儿期
B. 婴儿期
C. 幼儿期
D. 学龄前期
E. 学龄期

正确答案：C。幼儿期

解析：本题考查体格生长发育的相关内容。幼儿期（C对）为1～3岁，此期儿童神经系统发育开始减慢，脑的大小已达成人的80%。新生儿期（A错）指从胎儿娩出脐带结扎至不满28天，此期儿童身体各器官功能发育尚不完善。婴儿期（B错）指出生后至不满1岁，此期儿童体格生长发育和神经精神发育迅速。学龄前期（D错）指3～6岁，此期儿童语言、思维等能力发育较快。学龄期（E错）指7～12岁进入学校学习的阶段，此期儿童大脑皮层功能愈加发达，各种感知、记忆、思维能力进一步发展。